下列不是牙源性角化囊性瘤的临床表现的是
A. 牙源性颌骨囊肿生长缓慢
B. 扪诊时可有乒乓球样的感觉
C. 扪诊可发出所谓羊皮纸样脆裂声
D. 大多向舌侧膨胀
E. 好发于下颌支及下颌角

正确答案：D。大多向舌侧膨胀

解析：牙源性颌骨囊肿生长缓慢，初期无自觉症状。若继续生长，骨质逐渐向周围膨胀，则形成面部畸形。如果囊肿发展到更大时，表面骨质变为极薄之骨板，扪诊时可有乒乓球样的感觉，并发出所谓羊皮纸样脆裂声，最后，此层极薄的骨板也被吸收时，则可发生波动感。由于颌骨的颊侧骨板一般较舌侧为薄，所以一般囊肿大多向颊侧膨胀；但角化囊肿可有1/3病例向舌侧膨胀，并穿破舌侧骨壁。当下颌囊肿发展过大，骨质损坏过多时，可能引起病理性骨折。上颌骨的囊肿可侵入鼻腔及上颌窦，将眶下缘上推，而使眼球受到压迫，影响视力，甚或产生复视。如邻近牙受压，根尖周骨质吸收，可使牙发生移位、松动与倾斜。牙源性角化囊性瘤好发于下颌第三磨牙区及下颌支区。